哪项符合佝偻病激期改变
A. 血清钙正常
B. 血清磷增高
C. 钙磷乘积大多高于30
D. 碱性磷酸酶增高
E. 长骨x线检查骨质密度增高

正确答案：D。碱性磷酸酶增高

解析：激期（活动期）：血生化及骨骼X线改变：血钙稍降低，血磷明显降低，钙磷乘积常低于30，碱性磷酸酶明显增高。X线检查干骺端临时钙化带模糊或消失，呈毛刷样，并有杯口状改变；骺软骨明显增宽，骨骺与干骺端距离加大；骨质普遍稀疏，密度减低，可有骨干弯曲或骨折。掌握“维生素D缺乏性佝偻病”知识点。